与氢氧化钠溶液反应产生红色的是
A. 大黄素
B. 大黄素-β-葡萄糖苷
C. 二者均有此性质
D. 二者均无此性质

正确答案：C。二者均有此性质

解析：本题考查的是蒽醌类化合物的显色反应。与氢氧化钠溶液反应产生红色的是大黄素与大黄素-β-葡萄糖苷（C对）。Bornträger's反应：在碱性溶液中，羟基醌类颜色改变并加深，多呈橙、红、紫红及蓝色。如羟基蒽醌类化合物遇碱显红至紫红色，称为Bornträger's反应。蒽酚、蒽酮、二蒽酮类化合物需氧化形成羟基蒽醌后才能显色，其机制是形成了共轭体系。大黄素（A错）与大黄素-β-葡萄糖苷（B错）均属于羟基酮类，故可发生Bornträger's反应。